缓解急性心肌梗死疼痛最有效的药物是
A. 硝酸异山梨醇酯（消心痛）
B. 硝酸甘油
C. 吗啡
D. 安痛定
E. 硝苯地平（心痛定）

正确答案：C。吗啡

解析：缓解急性心肌梗死疼痛最有效的药物是吗啡（C对），它对一切疼痛都有较强的止痛效果。硝酸异山梨醇酯（消心痛）（A错）、硝酸甘油（B错）有扩冠的作用，安痛定（D错）可止痛、硝苯地平（心痛定）（E错）有降低心脏耗氧的作用，但都不是缓解急性心肌梗死疼痛最有效的药物。